对心肌收缩力抑制作用最强的钙离子通道阻滞药是
A. 尼莫地平
B. 尼群地平
C. 硝苯地平
D. 地尔硫䓬
E. 维拉帕米

正确答案：E。维拉帕米